子宫内膜异位症病灶最多见的部位是
A. 卵巢
B. 输卵管
C. 子宫后壁下段
D. 直肠子宫陷离
E. 宫骶韧带

正确答案：A。卵巢

解析：子宫内膜异位症是指子宫内膜组织（腺体和间质）出现在子宫体以外的部位。异位内膜可侵犯全身任何部位，如脐、膀胱、肾、输尿管、肺、胸膜、乳腺，甚至手臂、大腿等处，其中以卵巢（A对）最常见。